患者，男，48岁。十二指肠溃疡病史20年，近1个月来自感头痛、眩晕而就诊。检查：血压160/100mmHg(21.3/13.3kPa)，诊断为高血压。下列降压药应慎用的是
A. 可乐定
B. 利血平
C. 肼苯哒嗪
D. 氢氯噻嗪
E. 卡托普利

正确答案：B。利血平

解析：中年男性患者，有十二指肠溃疡病史20年，近期诊断查出高血压。利血平属于肾上腺能神经阻断剂，用药后交感神经系统的功能受到遏制，副交感神经系统的功能相对占优势，可使利血平的副作用如胃酸分泌增加，溃疡病恶变，引发消化道出血，甚至导致新的溃疡。故该患者应慎用利血平（B错，为本题正确答案）。可乐定(A对）属于中枢性降压药，禁用于患有精神疾病的患者。肼苯哒嗪（C对）属于血管扩张药，禁用于冠状动脉病变、脑血管硬化、心动过速及心绞痛患者。氢氯噻嗪（D对）属于利尿药，禁用于糖尿病、高尿酸血症或痛风病史者。卡托普利（E对）属于血管紧张素转化酶抑制剂，禁用于双侧肾动脉狭窄的患者。